长期服用可引起低磷血症的药物是
A. 兰索拉唑
B. 多潘立酮
C. 枸橼酸铋钾
D. 法莫替丁
E. 硫糖铝

正确答案：E。硫糖铝

解析：本题考查硫糖铝的不良反应。长期服用可引起低磷血症的药物是硫糖铝（E对）。硫糖铝主要的不良反应为便秘，偶见口干、恶心、腹泻等，长期服用可导致低磷血症。兰索拉唑（A错）长期服用影响钙吸收，可致骨质疏松；维生素B₁₂和维生素C吸收下降，增加感染风险，便秘、口干。多潘立酮（B错）可引起Q-T间期延长，导致心律失常，因此不宜与酮康唑口服制剂、红霉素或其他可能延长Q-T间期的CYP3A4酶强抑制剂（如氟康唑、伏立康唑、克拉霉素、胺碘酮、泰利霉素等）联用。枸橼酸铋钾（C错）主要不良反应是黑便，大量长期服用可有脑、肾毒性。法莫替丁（D错）不良反应可使驾驶员出现定向力障碍。